病例对照研究的资料分析中（分析整理表如下），要比较的是
A. a/a﹢b与c/c﹢d
B. a/a﹢c与d/b﹢d
C. a/a﹢c与b/b﹢d
D. b/a﹢b与d/c﹢d
E. a/a﹢d与c/c﹢d

正确答案：C。a/a﹢c与b/b﹢d